女，35岁。因尿频、尿急、尿痛2天就诊。体检：体温38.5℃，右肾区叩痛明显，尿常规蛋白（++），白细胞满视野，红细胞10～15个/HP。此时所给抗菌药物治疗方案应是
A. 单剂量疗法
B. 3天疗法
C. 2周治疗
D. 系统联合用药
E. 低剂量抑菌疗法

正确答案：C。2周治疗

解析：青年女性，出现尿频、尿急、尿痛症状（典型膀胱刺激症状），体温38.5℃（急性肾盂肾炎时常有发热，体温多在38.0℃以上）、右肾区叩击痛（提示肾脏病变），尿常规蛋白（++）（正常尿蛋白阴性），白细胞满视野（正常0～5个/HP，患者存在白细胞尿，提示有尿路感染），红细胞10～15个/HP（存在镜下血尿，正常0～3个/HP），综合该患者的病史、体查、实验室检查，该患者诊断考虑为急性肾盂肾炎。急性肾盂肾炎的抗菌药物治疗方案通常为2周（C对），常用药物有氧氟沙星、环丙沙星、阿莫西林和头孢呋辛等，2周后一般90%可治愈。如尿菌仍然阳性，应选用有效抗生素继续治疗4～6周。单剂量疗法（A错）即治疗方案采用一种或多种药物令患者一次顿服，主要用于治疗急性膀胱炎。3天疗法（B错）主要用于治疗急性膀胱炎。系统联合用药（D错）主要用于急性肾盂肾炎伴全身中毒症状明显者。低剂量抑菌疗法（P496）（E错）主要用于半年内发生2次以上重新感染者、尿路感染反复发作者。